镇痛药物分子中至少应具有的结构和药效基团为
A. 一个氮原子的碱性中心
B. 苯环
C. 苯并咪唑环
D. 萘环
E. 哌啶环或类似哌啶环结构

正确答案：A、B。一个氮原子的碱性中心；苯环

解析：本题考查镇痛药。镇痛药物分子中至少应具有的结构和药效基团为一个氮原子的碱性中心（A对）、苯环（B对）。镇痛药具有以下的共同结构特征：①分子中具有一个平坦的芳环结构；②有一个叔氮原子碱性中心，能在生理pH条件下大部分电离成阳离子，碱性中心和平坦结构在同一平面；③含有哌啶或类似哌啶的空间结构，而哌啶或类似哌啶的烃基部分，应凸出于由芳环构成的平面上方。苯并咪唑环（C错）、萘环（D错）可以提供一个平坦的芳环结构，但不是发挥药效的必需的，不能称为药效基团。哌啶环或类似哌啶环结构（E错），所连烃基突出于前方，满足构效的“氮原子碱性中心”和“凹槽”结构两条，但是只要同时具备“氮原子碱性中心”和“凹槽”结构就可以，不一定是哌啶或与哌啶类似的结构。